巨幼红细胞性贫血患者用下列哪种药物
A. 铁剂
B. 叶酸
C. 维生素C
D. 维生素K
E. 肝素

正确答案：B。叶酸

解析：巨幼红细胞性贫血是核酸合成障碍所致，核酸合成的必需原料是叶酸和维生素B12。对于营养不良或婴幼儿、妊娠期对叶酸的需要量增加所致的营养性巨幼红细胞性贫血，治疗时以叶酸为主（B对），辅以维生素B12。铁剂（A错）（P274）是治疗缺铁性贫血的首选药。维生素C（C错）是体内的一种维生素，抗氧化作用，对巨幼红细胞性贫血患者没有效果。维生素K（D错）主要影响凝血因子的合成。肝素（E错）（P263）是抗凝药，主要用于血栓性疾病的治疗。